下列哪项不是问卷中常用的答案格式
A. 填空式
B. 二项选择式
C. 多项选择式
D. 图表式和排序式
E. 简述式

正确答案：E。简述式